少阳病证的临床意义是
A. 邪犯胆腑，枢机不运，经气不利
B. 邪热内传，邪与水结，膀胱气化不利，水液停蓄
C. 太阳表证误下，邪陷太阴，脾伤气滞络瘀
D. 风寒侵犯太阳经脉，卫强营弱
E. 邪热内传，与血相结，瘀热结于少腹

正确答案：A。邪犯胆腑，枢机不运，经气不利

解析：少阳病证是指邪犯少阳，正邪分争，枢机不利，胆火内郁，经气不畅所表现的证（A对）。太阳蓄水证指太阳经证不解，邪热内传足太阳膀胱腑，邪与水结，膀胱气化不利，水液停蓄所表现的证（B错）。太阴腹痛证多由三阳病失治、误治，损伤脾阳，邪陷太阴，脾伤气滞络瘀（C错）。太阳中风证指以风邪为主的风寒之邪侵袭太阳经脉，致使卫强营弱所表现的证（D错）。太阳蓄血证指太阳经证未解，邪热内传，邪热与瘀血互结于少腹所表现的证（E错）。